气管
A. 位于喉与肺门之间
B. 于胸骨颈静脉切迹处，分为左、右主支气管
C. 在颈部不能触及
D. 在咽的前面下降
E. 在第2至第4气管软骨环前方有甲状腺峡

正确答案：E。在第2至第4气管软骨环前方有甲状腺峡

解析：在第2至第4气管软骨环前方有甲状腺峡（E对）。气管位于喉与气管杈之间（A错）。气管在胸骨角平面（约平第4胸椎体下缘），分叉形成左、右主支气管（B错）。